以下哪项不是照海穴的主治病证
A. 失眠、癫痫
B. 呕吐涎沫、吐舌
C. 月经不调、带下
D. 小便频数、癃闭
E. 咽喉干痛、目赤肿痛

正确答案：B。呕吐涎沫、吐舌

解析：照海不能治疗呕吐涎沫、吐舌（B对）。照海主治①失眠、癫痫(A错)等精神、神志疾患；②咽喉干痛、目赤肿痛（E错 ）等五官热性疾患；③月经不调、带下（C错）、阴挺等妇科病证；④小便频数，癃闭(D错)。